不属于病人权利的内容是
A. 受到社会尊重和理解
B. 遵守医疗部门规章制度
C. 享受医疗服务
D. 保守个人秘密
E. 免除或部分免除健康时的社会责任

正确答案：B。遵守医疗部门规章制度